下列哪项不是急性根尖周炎应急处理的原则
A. 消炎止痛
B. 安抚治疗
C. 调（牙合）止痛
D. 拔除患牙
E. 建立引流

正确答案：D。拔除患牙

解析：本题考查急性根尖周炎应急处理的原则。患牙若有保留价值应尽量通过根管治疗保存患牙，不能拔除患牙（D错，为本题的正确答案），即使患牙不能保留也不能在急性期拔除，应在炎症消退后拔除患牙，急性炎症期拔牙炎症易扩散且麻醉效果不好，所以拔出患牙不是急性根尖周炎应急处理的原则。急性根尖周炎患者需要即刻减轻疼痛，应急处理是初次治疗中需采取的重要措施。通过开髓建立引流（E对）通道可以引流炎症渗出物和缓解因之而形成的髓腔高压，以减轻剧痛。由外伤引起的急性根尖周炎，应调（牙合）磨改使患牙咬合降低，功能减轻，得以休息，达到调（牙合）止痛（C对）的目的。安抚治疗（B对）可以用镇痛剂如浸有丁香油酚镇痛剂的小棉球放在引起牙髓炎的深龋洞中达到暂时止痛的目的。一般可采用口服或注射的途径给予抗生素药物或止痛药物达到消炎止痛（A对）的目的。消炎止痛、安抚治疗、调牙合止痛、开髓引流均是急性根尖周炎应急处理的原则。